多个样本率比较的R×C表χ²检验，以下错误的一项是
A. 其备择假设是多个总体率不全相等
B. χ²的自由度是（R-1）（C-1）
C. χ²值越小，越有理由认为理论频数与实际频数符合的好
D. 由于格子数较多，可不必考虑每个格子的理论数的大小
E. 若P＜0.01，还不能推断每两个率值不等

正确答案：D。由于格子数较多，可不必考虑每个格子的理论数的大小